铅通过抑制巯基酶活性，可使
A. 血红蛋白合成减少
B. 血红蛋白分解增强
C. 锌、铁和钙等的吸收率增加
D. 维生素C氧化速度减慢
E. 1，25-（OH）₂-D₃的分解代谢减弱

正确答案：A。血红蛋白合成减少

解析：本题考查铅对营养素代谢的影响。铅通过抑制巯基酶活性，使血红蛋白合成减少（A对B错）。由于在肠道吸收过程中，铅与锌、铁和钙等矿物质的转运蛋白相同，相互间存在竞争性抑制作用，血铅增高会直接降低锌、铁和钙等的吸收率（C错）。铅可促进维生素C不可逆的氧化过程（D错），使其失去生理功能，如长期接触铅可引起机体血液和尿中维生素C水平下降，出现维生素C缺乏症。铅使1，25-（OH）₂-D₃的分解代谢加强（E错），活性型维生素D₃减少，影响钙的吸收和利用。